患者，男，63岁，既往患有高血压、2型糖尿病、高脂血症。目前使用硝苯地平控释片、盐酸二甲双胍片、阿卡波糖片、瑞舒伐他汀钙片。新诊断冠心病，给予阿司匹林肠溶片，单硝酸异山梨酯缓释片治疗。该患者入院后血压波动于160～169/85～96mmHg，查肝肾功能正常，需在原有高血压治疗方案基础上加用抗高血压药，该患者不宜选用的药物是
A. 吲达帕胺
B. 厄贝沙坦
C. 氢氯噻嗪
D. 氨氯地平
E. 福辛普利

正确答案：C。氢氯噻嗪

解析：本题考查抗高血压药物的应用。该患者高血压的同时患有糖尿病，氢氯噻嗪（C错，为本题正确答案）在患有糖尿病的情况下不宜使用。